应对由其调配的药品及其他职责范围内的关键药学技术业务负责是
A. 执业药师的责任
B. 执业药师的权力
C. 执业药师的义务
D. 执业药师的权利
E. 执业药师的执业行为规范

正确答案：E。执业药师的执业行为规范